可以用接触角进行评价的是
A. 流动性
B. 比表面积
C. 润湿性
D. 粒径
E. 孔隙率

正确答案：C。润湿性

解析：本题考查润湿性评价方法。固体与液体的润湿性（C对）可以通过两相之间的接触角来评价：接触角越大，润湿性越小。